患者肢体痿软无力，逐渐加重，伴有食少，便溏，腹胀，面色无华，气短，神疲乏力，舌苔薄白，脉细。其治法是
A. 清热润燥，养肺生津
B. 补脾益肾，化瘀通络
C. 补脾益气，健运升清
D. 补益肝肾，滋阴清热
E. 活血化瘀，舒筋活络

正确答案：C。补脾益气，健运升清

解析：题中患者以肢体痿软无力主症，故诊断为痿证。脾胃虚弱，气血化源不充，则筋脉失荣，故肢体痿软，渐渐加重。脾不健运，故食少。脾虚清阳不升，故便溏腹胀。气虚不能运化水湿，故气短。面色无华，神疲乏力，舌苔薄白，脉细，皆由脾胃虚弱、气血不足所致。题中辨证为痿证脾胃亏虚证，治宜补脾益气，健运升清（C对）。清热润燥，养肺生津为痿证肺热津伤证治法（A错）。补脾益肾为淋证之劳淋证的治法，化瘀通络为瘀血停留的治法（B错）。补益肝肾，滋阴清热为痿证肝肾亏损证治法（D错）。活血化瘀，舒筋活络用治外伤跌打肿痛（E错）。